以下关于边缘系统的描述，何者错误
A. 包括扣带回、海马旁回、海马结构、隔区等
B. 即边缘叶的别称
C. 杏仁体位于海马旁回钩的深面
D. 海马属于古皮质
E. 与内脏活动、情绪行为和记忆有关

正确答案：B。即边缘叶的别称

解析：边缘系统（B错，为本题正确答案）是由边缘叶（包括扣带回、海马旁回、海马结构、隔区等（A对））及与其密切相联系的皮质下结构，如杏仁核、隔核、下丘脑、背侧丘脑的前核和中脑被盖的一些结构等共同组成，其功能与内脏活动、情绪行为和记忆等有关（E对）。其中，海马结构包括海马和齿状回，海马是只有三层结构的古皮质（D对）；杏仁体位于海马旁回钩的深面（C对）。